混悬剂中药物粒子的大小一般为
A. ＜0.1nm
B. ＜1nm
C. ＜10nm
D. ＜100nm
E. 500nm～10000nm

正确答案：E。500nm～10000nm

解析：本题考查混悬剂。混悬剂中药物粒子的大小一般在0.5～10um之间（E对）。